十二指肠溃疡的发病特点及临床表现主要有
A. 多数疼痛有节律性
B. 在夏季发病较多
C. 上腹痛多出现于餐后2～4小时
D. 上腹痛多出现于餐后0.5～1小时
E. 进食可缓解疼痛

正确答案：A、C、E。多数疼痛有节律性；上腹痛多出现于餐后2～4小时；进食可缓解疼痛

解析：本题考查十二指肠溃疡的发病特点及临床表现。十二指肠溃疡发病时多数疼痛有节律性（A对）。在两餐之间出现上腹痛（C对D错），持续至下一餐进餐后可缓解（E对）。常在秋冬及冬春之交发病（B错）。